患者，男，60岁。心悸怔忡，健忘失眠，多梦，面色不华,舌质淡，脉细。其治法是
A. 滋阴养心
B. 滋补肝肾
C. 益气养阴
D. 养血安神
E. 清胃泻火

正确答案：D。养血安神

解析：心血不足，不能养心，故心悸怔忡，健忘失眠，多梦；心主血脉，其华在面，血虚故面色不华；舌为心苗，心主血脉，心血不足，故舌质淡，脉细。故辨证为心血不足证，治宜补血养心，益气安神（D对）。滋阴养心为虚劳心阴虚证的治法（A错）。滋补肝肾为肝肾阴虚的治法（B错）。益气养阴为肺痨气阴耗伤证的治法（C错）。清胃泻火为胃火炽盛的治法（E错）。